葡萄胎清宫术后3月，阴道不规则流血，子宫稍大，尿HCG（+），胸片示双下肺有多处片状阴影。最可能的诊断是
A. 葡萄胎残留
B. 先兆流产
C. 异位妊娠
D. 绒毛膜癌
E. 侵蚀性葡萄胎

正确答案：E。侵蚀性葡萄胎

解析：葡萄胎清宫术后3个月，阴道不规则流血（滋养细胞肿瘤表现为在葡萄胎排空、流产或足月产后，有持续的不规则阴道流血，量多少不定），子宫稍大（子宫复旧不全或不均匀性增大），尿hCG（﹢），胸片示双下肺有多处片状阴影（肺转移典型表现为棉球状或团块状阴影。转移灶以右侧肺及中下部较为多见），应考虑妊娠滋养细胞肿瘤，包括侵蚀性葡萄胎和绒毛膜癌。侵蚀性葡萄胎（E对）继发于葡萄胎排空后半年以内，一年以上者多数为绒毛膜癌（D错）。葡萄胎残留（P336）（A错）为良性病变，与侵蚀性葡萄糖临床症状相似，但不发生肺转移。先兆流产（P48）（B错）指妊娠28周前先出现少量阴道流血，随后出现阵发性下腹痛或腰背痛，妇检子宫大小与停经周数相符；异位妊娠（p53）（C错）早期常无特殊的临床表现，与早孕或先兆流产相似，晚期发生破裂时，突感一侧下腹部撕裂样疼痛，伴恶心呕吐，常有不规则阴道流血，妇检子宫大小与停经月份相符，两者均无肺转移征象。